伯氏疏螺旋体主要引起哪种疾病
A. 回归热
B. 狂犬病
C. 莱姆病
D. 波浪热
E. 钩体病

正确答案：C。莱姆病